地龙咸寒清泄，走窜通利，其不具有的功效是
A. 清热息风
B. 化痰散结
C. 平喘
D. 通络
E. 利尿

正确答案：B。化痰散结

解析：本题考查地龙的功效。地龙咸寒清泄，走窜通利，其不具有的功效是化痰散结（B错，为本题正确答案）。地龙【功效】清热息风（A对），平喘（C对），通络（D对），利尿（E对）。